属于脱敏牙膏成分的是
A. 洗必泰
B. 单氟磷酸钠
C. 氯化钾
D. 三氯羟苯醚
E. 氧化剂

正确答案：C。氯化钾

解析：市场上的抗牙本质敏感牙膏主要通过两种机制缓解牙本质敏感。一类作用于神经细胞外部，通过去极化抑制神经疼痛信号传导而减轻外部刺激带来的痛觉。这一类以可溶性钾盐为主，如硝酸钾和氯化钾。另一类抗牙本质敏感牙膏通过堵塞暴露的牙本质小管口阻隔外界刺激而减轻牙本质敏感。这一类常见的有氟化亚锡或其他亚锡盐类、乙酸锶、Novamin、磷硅酸钙钠和精氨酸等。掌握“自我口腔保健方法”知识点。